可复性盘前移位开口型
A. 偏向患侧
B. 偏向健侧
C. 先偏向患侧后又回到中线
D. 不偏
E. 开口型歪曲

正确答案：C。先偏向患侧后又回到中线

解析：可复性关节盘前移位表现：开口型由弹响发生前偏向患侧，弹响发生后又回到中线。掌握“颞下颌关节紊乱”知识点。